失血性休克时最易受损的器官是
A. 心
B. 脑
C. 肝
D. 肺
E. 肾

正确答案：E。肾

解析：肾（E对ABCD错）是失血性休克时最易受损的器官，大量失血后，血容量迅速减少。为保证心脑血液供应，血液发生重新分配，故休克早期就出现肾血流灌注不足，导致急性肾衰，即休克肾。